属于颈内动脉的分支的是
A. 大脑中动脉
B. 脑膜中动脉
C. 小脑上动脉
D. 大脑后动脉
E. 迷路动脉

正确答案：A。大脑中动脉

解析：脑的动脉来源于颈内动脉和椎动脉。颈内动脉的分支包括大脑前动脉、大脑中动脉（A对）等。基底动脉由左、右椎动脉汇合而来，其分支包括小脑上动脉（C错）、大脑后动脉（D错）、迷路动脉（E错）等。脑膜中动脉（B错）属于颈外动脉分支之一上颌动脉的分支。